在五色主病中青色主
A. 寒证
B. 热证
C. 虚证
D. 湿证
E. 水饮

正确答案：A。寒证

解析：由于寒邪凝滞，或气滞血瘀，或疼痛剧烈，或筋脉拘急，或热盛动风，致脉络阻滞，血行不畅，故见青色（A对）。红色主热证，亦可见于真寒假热之戴阳证（B错）。白色主虚证、寒证、失血、夺气（C错）。黄色主脾虚、湿证（D错）。黑色主肾虚、寒证、水饮、血瘀、疼痛（E错）。